马血清抗毒素是
A. 是抗体，不是抗原
B. 是抗原，不是抗体
C. 即是抗体，又是异种抗原
D. 即非抗原，又非抗体
E. 是异嗜性抗原

正确答案：C。即是抗体，又是异种抗原